构成比之和为
A. 1
B. ＜100％
C. ＞100％
D. 100
E. 不确定值

正确答案：A。1